胰头癌最主要的临床表现是
A. 上腹不适
B. 上腹疼痛
C. 黄疸
D. 腹水
E. 上腹肿块

正确答案：C。黄疸

解析：黄疸（C对）是胰头癌最主要的临床表现，多数是由胰头癌压迫或浸润胆总管所致，呈进行性加重。黄疸出现的早晚和肿瘤的位置密切相关，癌肿距离胆总管越近，黄疸出现越早。胆道梗阻越完全，黄疸越深。胰头癌早期可有上腹疼痛（A错）、不适（B错）及食欲不振、消化不良、腹泻等消化道症状，晚期常可扪及上腹部肿块（E错），可有腹水征（D错），少数患者还有左锁骨上淋巴结肿大。以上均为胰腺癌一般症状及体征，非最突出临床表现。